男性，70岁。下楼时不慎摔伤右髋部。查体：右下肢缩短，外旋50°畸形，右髋肿胀不明显，但有叩痛。该患者最易发生的并发症是
A. 脂肪栓塞
B. 坐骨神经损伤
C. 髋内翻畸形
D. 股骨头缺血性坏死
E. 髋关节周围创伤性骨化

正确答案：D。股骨头缺血性坏死

解析：患者老年男性，右髋部摔伤，右髋肿胀、有叩痛（提示可能为股骨颈骨折），结合患者病史和体查，考虑患者最可能的诊断为右股骨颈骨折。股骨颈骨折最易发生的并发症是股骨头缺血性坏死（D对），最多见于股骨头下型骨折。脂肪栓塞（A错）为骨折的早期并发症，多见于股骨等长骨骨干骨折。坐骨神经损伤（B错）可见于髋关节后脱位。髋内翻畸形（C错）可见于股骨转子间骨折，但大多为先天性疾病。创伤性骨化（E错）多见于关节扭伤、脱位或关节附近骨折。